善治血热便血、痔血及肝热目赤头痛的药物是
A. 虎杖
B. 槐花
C. 小蓟
D. 地榆
E. 大蓟

正确答案：B。槐花

解析：血热便血、痔血，治宜凉血止血，肝热目赤头痛，治益清肝泻火。槐花具有凉血止血，清肝泻火的功效（B对）。虎杖有利湿退黄，清热解毒，散瘀止痛，化痰止咳的功效，无凉血止血之功（A错）。小蓟具有凉血止血，散瘀解毒消痈的功效，无清肝泻火之功（C错）。地榆具有凉血止血，解毒敛疮的功效，无清肝泻火之功（D错）。大蓟具有凉血止血，散瘀解毒消痈的功效，无清肝泻火之功（E错）。